关于缓释制剂、控释制剂特点的说法，错误的是
A. 缓释制剂、控释制剂的给药次数较普通制剂少
B. 缓释制剂、控释制剂的治疗作用较普通制剂更持久
C. 缓释制剂、控释制剂血药浓度波动较普通制剂小
D. 缓释制剂、控释制剂较普通制剂更具靶向性
E. 缓释制剂、控释制剂较普通制剂更能增加患者的顺应性

正确答案：D。缓释制剂、控释制剂较普通制剂更具靶向性

解析：本题考查的是缓释、控释制剂的特点。缓释制剂、控释制剂不具靶向性（D错，为本题正确答案）。缓释制剂系指在规定释放介质中，按要求缓慢地非恒速释放药物，其与相应的普通制剂比较，给药频率比普通制剂减少一半或给药频率比普通制剂有所减少（A对），且能显著增加患者的顺应性的制剂（E对）。控释制剂系指在规定释放介质中，按要求缓慢地恒速释放药物，其与相应的普通制剂比较，给药频率比普通制剂减少一半或有所减少，血药浓度比缓释制剂更加平稳，且能显著增加患者的顺应性的制剂。缓释、控释制剂的特点：与普通制剂比较，缓释、控释制剂具有以下特点：①药物治疗作用持久（B对）、毒副作用小、用药次数显著减少。②药物可缓慢地释放进入体内，血药浓度的“峰谷”波动小（C对），可避免超过治疗血药浓度范围的毒副作用，又能保持在有效浓度治疗范围（治疗窗）之内以维持疗效。